经过海绵窦外侧壁的结构是
A. 眼神经
B. 舌咽神经
C. 副神经
D. 前庭蜗神经
E. 无

正确答案：A。眼神经

解析：眼神经（A对）从三叉神经节发出，穿经海绵窦外侧壁。舌咽神经（B错）连于延髓橄榄后沟上部，与迷走神经、副神经同穿颈静脉孔前部出入颅腔。副神经（C错）起自疑核（延髓根）和副神经核（脊髓根），连于延髓橄榄后沟下部。前庭蜗神经（D错）连于脑桥延髓沟外侧部，居面神经外侧。